室间隔缺损初期所引起的血液分流方向是
A. 自右向左
B. 自左向右
C. 双向分流
D. 先向左，后向右
E. 先向右，后向左

正确答案：B。自左向右